诊断心肌病最常用的辅助检查是
A. 心电图
B. 超声心动图
C. 冠状动脉造影
D. 心内膜心肌活检
E. 胸部X线检查

正确答案：B。超声心动图

解析：临床常见的3种心肌病为扩张型、肥厚型、限制型心肌病。超声心动图可明确心室扩大、心肌肥厚和各瓣膜情况，对扩张型和肥厚型心肌病的诊断具有重要价值，但对限制型诊断价值不大。由于扩张型心肌病约占90%以上，而限制型心肌病极为少见，因此本题的最佳答案仍为超声心动图（B对）。心电图（A错）主要用于心律失常的诊断。冠状动脉造影（C错）主要用于冠心病的诊断。心内膜心肌活检（D错）为有创检查方法，临床上少用。胸部X线片（E错）为影像学检查，缺乏诊断特异性。